宫颈炎症与宫颈癌早期肉眼难以鉴别，确诊方法应是
A. 宫颈刮片细胞学检查
B. 宫颈碘试验
C. 阴道镜检查
D. 宫颈及宫颈管活检
E. 氮激光肿瘤固有荧光诊断法

正确答案：D。宫颈及宫颈管活检

解析：活组织病理检查是确诊临床疾病的金标准，宫颈炎症与宫颈癌鉴别的确诊方法是宫颈及宫颈管活检（D对）。宫颈刮片细胞学检查（P405）（A错）是筛查早期子宫颈癌的重要方法。宫颈碘试验（P303）（B错）主要用于病变部位的定位。阴道镜检查（P443）（C错）是将子宫颈或生殖器表皮组织进行光学放大，观察子宫颈上皮及血管的变化，结合活检，以提高宫颈疾病确诊率。氮激光肿瘤固有荧光诊断法（E错）主要用于癌症的早期筛查，可通过分析被检组织发出的荧光色泽判断其是否癌变或癌前病变。